男，60岁。发现全程肉眼血尿伴条状血凝块1周，无尿频、尿急、尿痛。B超检查显示左肾实质占位，肿块直径55mm。为明确肿块性质，进一步检查首选
A. 尿细胞学检查
B. 肾动脉造影
C. 静脉尿路造影
D. 腹部CT平扫+增强
E. 尿路平片

正确答案：D。腹部CT平扫+增强

解析：老年男性患者，无痛性肉眼血尿伴条状血凝块（提示可能有上尿路肿瘤），B超检查显示左肾实质占位（提示可能为肾盂癌，肾癌无条状血凝块），结合患者临床表现和B超检查，应考虑左肾盂癌。为明确肿块性质，进一步检查应首选腹部CT平扫+增强（D对）。肾动脉造影（B错）适用于肾血管疾病、肾损伤和肾癌的诊断，且价格昂贵，一般不作为首选检查。静脉尿路造影（C错）用于显示尿路有无梗阻、了解分侧肾功能，多用于肾结核、尿路结石的诊断。对于尿脱落细胞学（A错）或 FISH 检查为阳性，而膀胱镜检查正常者，一般提示存在肾盂、输尿管癌。尿路平片（E错）多用于尿路结石的诊断。